以下关于桩冠固位的说法哪项是错误的
A. 粘接力是最主要的固位力
B. 桩与根管壁要密合
C. 桩越长固位越好
D. 桩直径与固位有关
E. 桩形态影响固位

正确答案：A。粘接力是最主要的固位力

解析：本题考查桩冠固位。桩核冠的固位力主要来源于摩擦力和粘接力两部分，粘接力是其中之一（A错，为本题的正确答案）。桩与根管壁要密合（B对），以保证固位良好，受力时能均匀传递应力。桩越长固位越好（C对），桩越长，摩擦力和粘接面积就越大，固位力就越强。桩直径与固位有关（D对），增大桩的直径，也就增大了桩和根管内壁的接触面积，既增加了固位力，又增加了抗力性。桩形态影响固位（E对），柱形桩的固位好于锥形桩。